两药同时使用时，一个药物可通过诱导体内生化反应而使另一个药物的药效降低。下列药物同时使用时，会发生这种相互作用的是
A. β受体阻断剂阿替洛尔与利尿药氢氯噻嗪
B. 抗痛风药丙磺舒与青霉素
C. 解热镇痛药阿司匹林与对乙酰氨基酚
D. 抗菌药磺胺甲噁唑与甲氧苄啶
E. 抗癫痫药苯巴比妥与避孕药

正确答案：E。抗癫痫药苯巴比妥与避孕药

解析：本题考查药物的相互作用。抗癫痫药苯巴比妥与避孕药（E对）合用：苯巴比妥能够诱导肝微粒体酶活性，使避孕药代谢加速，效应降低，使避孕失败；β受体阻断剂阿替洛尔与利尿药氢氯噻嗪（A错）合用：阿替洛尔是β受体阻断剂，可以用于高血压，冠心病，心律失常的治疗；氢氯噻嗪是利尿药物，可以用于高血压和水肿的治疗，2种药物合用可以治疗高血压；抗痛风药丙磺舒与青霉素（B错）合用抗菌作用增强；解热镇痛药阿司匹林与对乙酰氨基酚（C错）合用可使解热、镇痛作用相加。